在测定基础代谢率时，错误的是
A. 在清晨、卧床、醒来前进行
B. 无肌肉活动
C. 无精神紧张
D. 室温20～25℃
E. 测定前至少禁食12小时

正确答案：A。在清晨、卧床、醒来前进行